必需脂肪酸提供热能占总热能的
A. 3%以上
B. 10%～12%
C. 12%～14%
D. 20%～30%
E. 50%～65%

正确答案：A。3%以上